驱虫兼具疗癣功效的药物是
A. 使君子
B. 苦楝皮
C. 槟榔
D. 雷丸
E. 榧子

正确答案：B。苦楝皮

解析：苦楝皮苦燥寒清，有毒而力较强，入脾、胃、肝经。内服善毒杀蛔虫、蛲虫、钩虫，治蛔、蛲、钩虫病。外用能除湿热、杀灭皮肤寄生虫及抑制致病真菌，治头癣、疥疮（B对）。使君子（A错）的功效是杀虫消积。槟榔（C错）的功效是杀虫，消积，行气，利水，截疟。雷丸（D错）的功效是杀虫消积。榧子（E错）的功效是杀虫消积，润肺止咳，润燥通便。